具有补脾止泻，养心安神功效的药物是
A. 山茱萸
B. 五倍子
C. 莲子
D. 诃子
E. 金樱子

正确答案：C。莲子

解析：该题考查莲子的功效。莲子味甘、涩，性平，归脾、肾、心经，其功效为益肾固精，补脾止泻，止带，养心安神（C对）。